与碱作用发生开环的化合物是
A. 厚朴酚
B. 麻黄素
C. 大黄素
D. 紫草素
E. 紫花前胡内酯

正确答案：E。紫花前胡内酯

解析：本题考查的是香豆素的理化性质。与碱作用发生开环的化合物是紫花前胡内酯（E对）。香豆素类及其苷因分子中具有内酯环，在热稀碱溶液中内酯环可以开环生成顺邻羟基桂皮酸盐。紫花前胡内酯属于呋喃香豆素类。厚朴酚（A错）为厚朴的主要成分，属于木脂素类化合物。麻黄素（B错）为麻黄的主要成分，属于生物碱类化合物。大黄素（C错）为大黄的主要成分，属于蒽醌类化合物。紫草素（D错）是紫草的主要成分，属于萘醌类化合物。